右心房内可见到
A. 卵圆窝
B. 乳头肌
C. 二尖瓣
D. 腱索
E. 肺静脉瓣

正确答案：A。卵圆窝

解析：卵圆窝（A对）在右心房内可见到。是胚胎时期卵圆孔闭合后的遗迹，此处薄弱，是房间隔缺损的好发部位。